目前对儿童支气管哮喘慢性持续期，首选的药物治疗是
A. 静脉应用氨茶碱
B. 口服白三烯调节剂
C. M受体拮抗剂吸入
D. β₂受体激动剂吸入
E. 糖皮质激素吸入

正确答案：E。糖皮质激素吸入

解析：哮喘，是儿童期最常见的慢性炎症性呼吸道疾病，可逆性的气流受限是其特点，因ⅠCS（吸入型糖皮质激素）（E对）如，布地奈德、丙酸弗替卡松、丙酸倍氯米松直接作用于气道黏膜，局部作用强而全身不良反应小，可长期用于哮喘持续期。静脉应用氨茶碱（A错）主要用于哮喘危重状态治疗；口服白三烯调节剂（B错）、β₂受体激动剂吸入（D错）可用于哮喘慢性持续期的辅助治疗；M受体拮抗剂吸入（C错）辅助治疗哮喘急性发作期（首选β₂受体激动剂吸入）。